先天性巨结肠最常见的并发症是
A. 肠梗阻
B. 败血症
C. 营养不良
D. 小肠结肠炎
E. 肠穿孔

正确答案：D。小肠结肠炎

解析：先天性巨结肠，是由直肠或结肠远端的肠管持续痉挛，粪便歡滞在近端结肠，使该肠管肥厚、扩张而导致。败血症（B错）、小肠结肠炎、肠穿孔（E错）都是先天性巨结肠的并发症，但最常见的是小肠结肠炎（D对）。肠梗阻（A错）和营养不良（C错）均是先天性巨结肠的临床表现，而不是并发症。